川楝子的主治病证是
A. 肝郁胁痛兼热
B. 肝郁胁痛兼寒
C. 肝郁胁痛兼食积
D. 肝郁胁痛兼淤血
E. 肝郁胁痰饮

正确答案：A。肝郁胁痛兼热

解析：本题考查的是川楝子的性能特点。川楝子的主治病证是肝郁胁痛兼热（A对）。川楝子：【性能特点】本品苦泄寒清，有小毒，力较强。入肝、胃、小肠、膀胱经。既疏肝泄热、行气止痛，治肝郁气滞或肝胃不和诸痛，兼热者最宜。以毒攻毒，内服能杀虫，外用能疗癣。